龋损病变进展到牙本质深层，患牙明显食物嵌塞痛，但没有自发性疼痛，应该诊断为
A. 浅龋
B. 猛性龋
C. 中龋
D. 静止龋
E. 深龋

正确答案：E。深龋

解析：深龋：病变进展到牙本质深层，患牙有明显的遇冷热酸甜刺激敏感症状，也可有食物嵌塞时的短暂疼痛症状，但没有自发性疼痛。掌握“龋病的诊断及鉴别诊断”知识点。